对某病患病率调查，若在某市许多工厂中抽查一个大工厂，并按不同工种抽取一定比例的工人进行调查，属于
A. 随机抽样
B. 机械抽样
C. 分层抽样
D. 多阶段抽样
E. 整群抽样

正确答案：E。整群抽样

解析：本题考查整群抽样的概念。整群抽样是将总体分成若干群组，抽取其中部分群组作为观察单位组成样本，这种抽样方法称为整群抽样。本题中抽查一个大工厂，并按不同工种抽取一定比例的工人进行调查，属于整群抽样（E对ABCD错）。